饭后困倦嗜睡，少气懒言，食量减少的临床意义是
A. 痰湿困脾
B. 脾气不足
C. 心肾阳虚
D. 邪闭心神
E. 热入营血

正确答案：B。脾气不足

解析：饭后困倦嗜睡，纳呆腹胀，少气懒言，食量减少者，多因脾气虚，脾失健运，清阳不升，脑失所养引起（B对）。痰湿困脾则困倦嗜睡，头目昏沉，胸闷脘痞，肢体困重多由痰湿困脾，清阳不升导致（A错）。心肾阳虚则会导致精神极度疲惫，神识朦胧，困倦易睡，肢冷脉微（C错）。嗜睡伴轻度意识障碍，叫醒后不能正确回答问题者多由邪闭心神引起（D错）。营血亏虚 ，不能奉养心神，心神失养则失眠（E错）。